1999年5月1日起实施的新药批准文号的格式是
A. 国药准字×××××××××
B. （年号）国药准字××号
C. 国药准字（年号）××号
D. 国药准字Z××××××××
E. 国药准字S××××××××

正确答案：D、E。国药准字Z××××××××；国药准字S××××××××

解析：本题考查药品批准文号的格式。1999年5月1日起实施的新药批准文号的格式是国药准字Z××××××××（D对）、国药准字S××××××××（E对）。药品批准文号的格式为：国药准字H（Z、S、J）+4位年号+4位顺序号，其中H代表化学药品，Z代表中药，S代表生物制品，J代表进口药品分包装。